男，21岁。车祸致左髋关节受伤，出现左髋部疼痛、外展、外旋、屈曲畸形，弹性固定。正确的诊断是
A. 股骨颈骨折
B. 髋关节后脱位
C. 骨盆骨折
D. 髋关节中心性脱位
E. 髋关节前脱位

正确答案：E。髋关节前脱位

解析：患者左髋关节外伤史，左髋关节外展、外旋、畸形，弹性固定，诊断考虑髋关节前脱位（E对）。髋关节前脱位患者有强大暴力所致外伤史，患肢呈外展、外旋和屈曲畸形。股骨颈骨折（P659）（A错）表现为屈髋、屈膝及外旋畸形，但一般没有弹性固定（弹性固定是脱位的专有体征）。（P655）髋关节后脱位（B错）表现为患肢缩短和髋关节屈曲、内收、内旋畸形。骨盆骨折（P681）（C错）表现为会阴部瘀斑，骨盆分离试验与挤压试验阳性等体征。髋关节中心性脱位（P657）（D错）表现为伤处肿胀、疼痛、活动障碍，大腿上外方血肿等。